有机磷化合物取代基不同其毒性不同，下列哪项正确
A. R1、R2同为乙基时毒性比甲基毒性大
B. R1、R2同为乙基时毒性比乙基大
C. Y基团为0时毒性大于S
D. X基团为酸根时，强酸毒性比弱酸毒性大
E. 以上都对

正确答案：E。以上都对